某女，18岁，今年如愿考上了大学，参加新生体检时，身高160cm，体重75kg。根据BMI判断，她的营养状况为
A. 营养不良
B. 正常
C. 超重
D. 肥胖
E. 极度肥胖

正确答案：D。肥胖